成人巨大睾丸鞘膜积液，最佳治疗措施是
A. 睾丸鞘膜翻转
B. 鞘膜囊全部切除
C. 等待自行吸收消退
D. 内环处高位结扎鞘状突
E. 鞘膜积液穿刺抽液

正确答案：A。睾丸鞘膜翻转

解析：成人的睾丸鞘膜积液，如积液量少，无任何症状，不需要手术治疗。积液量多，体积大伴明显的症状，应施行睾丸鞘膜翻转术（A对）。鞘膜囊全部切除（B错）主要用于治疗精索囊肿。婴儿的鞘膜积液常可自行吸收消退（C错），可不急于手术治疗。内环处高位结扎鞘状突（D错）主要用于交通性鞘膜积液。鞘膜积液穿刺抽液（E错）可用于治疗小儿鞘膜积液。